影响手性药物对映体之间活性差异的因素是
A. 解离度
B. 分配系数
C. 立体构型
D. 空间构象
E. 电子云密度分布

正确答案：C。立体构型

解析：本题考查药物的手性特征及其对药物作用的影响。立体构型（C对）是影响手性药物对映体之间活性差异的因素。当药物分子含对称因素后，得到一对互为物体与镜像关系的立体异构体，即对映异构体。对映异构体的化学性质、物理性质无差别，仅仅是旋光性不同。但值得注意的是，药物的对映异构体之间在生物活性上有时存在很大的差别，故影响手性药物对映体之间活性差异的因素是立体构型（旋光性）。一般情况下药物以分子型被吸收，因此解离度（A错）不是影响手性药物对映体之间活性差异的因素。脂水分配系数（B错）是评价药物脂溶性的参数。空间构象（D错）是指分子中原子或基团在三维空间的取向和定位。电子云密度（E错）是空间某处电子的疏密程度，决定的是原子的成键方向和成键强度。